具有喜润恶燥特性的脏腑是
A. 肝
B. 心
C. 脾
D. 胃
E. 大肠

正确答案：D。胃

解析：胃有喜润而恶燥的生理特性，胃主受纳腐熟，不仅依赖胃气的推动，亦需胃中津液的濡润，胃中津液充足，则能维持其受纳腐熟机能和通降下行的特性，胃为阳土，其病易成燥热之害，胃中津液每多受损，所以临床治疗胃疾，强调保护胃中津液（D对）。肝（A错）的生理特性是肝为刚脏和肝气升发。肺（B错）的生理特性是肺为华盖，肺为娇脏和肺气宣降。脾（C错）喜燥恶湿。大肠（E错）的生理特性是主传化糟粕与主津。